末梢血中白细胞计数总数减少见于
A. 急性阑尾炎
B. 急性白血病
C. 肺炎链球菌性肺炎
D. 肠伤寒
E. 恶性肿瘤

正确答案：D。肠伤寒